中度精神发育迟滞的IQ值范围为
A. 55～69
B. 45～59
C. 35～49
D. 25～39
E. ＜25

正确答案：C。35～49

解析：精神发育迟滞的IQ值范围：中度 35～49（C对）。轻度 50～69 ；重度 20～34 ；极重度＜20（ABDE错）。